下列不属于阿托品临床应用的是
A. 解除平滑肌痉挛
B. 抑制腺体分泌
C. 治疗青光眼
D. 抗休克
E. 解救有机磷酸酯类中毒

正确答案：C。治疗青光眼

解析：临床应用①解除平滑肌痉挛：适用于各种内脏绞痛，对胃肠绞痛，膀胱刺激症状如尿频、尿急等疗效较好。对胆绞痛或肾绞痛疗效较差，需与阿片类镇痛药合用。②抑制腺体分泌：用于全身麻醉前给药，以减少呼吸道腺体及唾液腺分泌，防止分泌物阻塞呼吸道及吸入性肺炎的发生。也可用于严重的盗汗及流涎症。③眼科：虹膜睫状体炎：0.5%～1%阿托品溶液滴眼，可松弛虹膜括约肌和睫状肌，使之充分休息，有助于炎症消退。尚可与缩瞳药交替应用，预防虹膜与晶状体的粘连。验光、检查眼底：眼内滴用阿托品可使睫状肌松弛，具有调节麻痹作用，此时由于晶状体固定，可准确测定晶状体的屈光度，亦可利用其扩瞳作用以利检查眼底。但阿托品作用持续时间较长，现已少用。只有儿童验光时，因儿童的睫状肌调节功能较强，仍用之。缓慢型心律失常：阿托品可用于治疗迷走神经过度兴奋所致的窦房阻滞、房室阻滞等缓慢型心律失常。阿托品对迷走神经张力过高或房室传导阻滞的患者通过改善心率和减轻房室结阻滞以维持合适的血流动力学来缓解临床症状。但阿托品剂量需谨慎调节，剂量过低可致进一步的心动过缓，剂量过大则引起心率加快，增加心肌耗氧量而加重心肌梗死，并有引起室颤的危险。④抗休克：大剂量阿托品能解除血管痉挛，舒张外周血管，改善微循环，可用于暴发型流行性脑脊髓膜炎、中毒性菌痢、中毒性肺炎等所致的感染性休克患者。⑤解救有机磷酸酯类中毒。掌握“阿托品”知识点。